有头疽最常见的并发症是
A. 内陷
B. 走黄
C. 伤筋
D. 损骨
E. 流注

正确答案：A。内陷

解析：内陷为疮疡阳证疾患过程中，阴正气内虚，火毒炽盛，导致毒邪走散，正不胜邪，毒不外泄，反陷于里，客于营血，内传脏腑的一种危急疾病。因多由有头疽患者并发，故名疽毒内陷（A对）。走黄是疔疮火毒炽盛，早期失治，毒势未能及时控制，走散入营，内攻脏腑而引起的一种全身性危急疾病，是疔疮的并发症（B错）。有头疽发于肌肤间，位置相对表浅，不会伤筋损骨（CD错）。流注是发于肌肉深部的急性化脓性疾病（E错）。